以下哪项不是口腔预防医学研究的基本要素
A. 群体的口腔疾病患病情况
B. 群体预防措施
C. 个人预防方法
D. 地区流行状况
E. 个人保健方法

正确答案：D。地区流行状况

解析：本题考查口腔预防医学的对象。地区流行状况（D错，为本题的正确答案）不是口腔预防医学研究的基本要素。口腔预防医学以人群为主要研究对象，以研究群体的口腔疾病患病情况（A对）、群体预防措施（B对）和个人预防保健方法（CE对）为基本要素，通过研究，发现并掌握预防口腔疾病发生与发展的规律，促进整个社会口腔健康水平的提高。